肾病及寒水上泛证患者，其口味应是
A. 口苦
B. 口淡
C. 口咸
D. 口酸
E. 口腻

正确答案：C。口咸

解析：肾虚或寒证患者自觉口中有咸味。因咸入肾，肾阴不足，虚火上炎；又或肾阳亏虚，寒水上泛，皆可令口中有咸味（C对）。口苦表现为患者自觉口中有苦味，见于实热证，尤以心、肝、胆火旺者多见（A错）。口淡表现为患者味觉减退，口中乏味，常伴食欲减退，属脾胃虚弱，或寒湿内阻，因脾胃运化减弱，饮食不上承于口，故口淡乏味（B错）。口酸表现为患者口中泛酸水或有酸馊味，属肝胃郁热，或伤食证（D错）。口黏腻表现为患者自觉口中胶黏不适，多由湿浊困阻中焦所致，如脾胃湿热、食积化热、痰热内盛等，皆可见口中黏腻不适（E错）。